治疗疮疡半阴半阳证，应首选
A. 冲和膏
B. 玉露膏
C. 阳和膏
D. 回阳玉龙膏
E. 生肌白玉膏

正确答案：A。冲和膏

解析：冲和膏活血止痛、祛风散寒，适用于半阴半阳证（A对）。玉露膏（B错）适用于疮疡阳证，对局部灼热明显、肿势散漫者效果更佳。阳和膏（C错）又名阳和解凝膏，温经和阳、祛风散寒、化痰通络，适用于阴证。回阳玉龙膏（D错）有温经散寒、活血化瘀的作用，适用于阴证。生肌白玉膏（E错）润肤生肌收敛，适用于溃疡已净，疮口不敛者。